石菖蒲的主治病证是
A. 热闭神昏
B. 气厥神昏
C. 亡阳神昏
D. 气脱神昏
E. 痰湿蒙蔽心窍之神昏

正确答案：E。痰湿蒙蔽心窍之神昏

解析：本题考查的是石菖蒲的主治病证。石菖蒲的主治病证是痰湿蒙蔽心窍之神昏（E对）。石菖蒲：【主治病证】（1）痰湿蒙蔽心窍之神昏，癫痫，耳聋，耳鸣。（2）心气不足之心悸失眠、健忘恍惚。（3）湿浊中阻之脘腹痞胀，噤口痢。冰片：【主治病证】（1）热病神昏（A错），中风痰厥，中恶神昏，胸痹心痛。（2）疮疡肿毒，咽喉肿痛，口舌生疮，目赤肿痛，耳道流脓。冰片性微寒，为凉开之品，主治热闭神昏，兼治寒闭。主治病证为气厥神昏（B错）、亡阳神昏（C错）与气脱神昏（D错）的中药，2022年考试指南未明确说明。